黄芩粉末的显微特征有
A. 韧皮纤维梭形，单个散在或数个成束
B. 石细胞壁厚，孔沟有时分叉
C. 草酸钙簇晶多见
D. 网纹导管多见
E. 淀粉粒甚多，单粒直径2-10㎛

正确答案：A、B、D、E。韧皮纤维梭形，单个散在或数个成束；石细胞壁厚，孔沟有时分叉；网纹导管多见；淀粉粒甚多，单粒直径2-10㎛

解析：本题考查的是黄芩的显微鉴别。黄芩粉末的显微特征有韧皮纤维梭形，单个散在或数个成束（A对）、石细胞壁厚，孔沟有时分叉（B对）、网纹导管多见（D对）、淀粉粒甚多，单粒直径2-10㎛（E对）。黄芩【显微鉴别】粉末：黄色。①韧皮纤维甚多，呈梭形，长60～250㎛，直径9～33㎛，壁甚厚，孔沟明显。②木纤维较细长，两端尖，壁不甚厚。③石细胞较多，呈类圆形、长圆形、类方形或不规则形，长60～160㎛，壁厚可至24㎛。④网纹导管多见，具缘纹孔及环纹导管较少。⑤木栓细胞多角形，棕黄色。⑥木薄壁细胞及韧皮薄壁细胞纺锤形，有的中部具横隔。⑦淀粉粒单粒类球形，直径2～10㎛，复粒由2～3分粒组成，少见。